导致新生儿胆红素生成过多的疾病是
A. 新生儿败血症
B. 先天性甲状腺功能减退症
C. 先天性胆道闭锁
D. 新生儿窒息
E. 胆汁粘稠综合征

正确答案：A。新生儿败血症

解析：新生儿败血症可引发溶血，因此新生儿败血症能导致新生儿胆红素生成过多的疾病是新生儿败血症（A对）。先天性甲状腺功能减退症（B错）由于甲状腺激素分泌减少引起代谢功能低下，新生儿窒息（D错）由于缺氧而引起代谢功能低下，当机体代谢功能低下时，胆红素生成会减少而不是增多。先天性胆道闭锁（C错）和胆汁粘稠综合征（E错）都是因胆道梗阻引起的黄疸，并不会引起胆红素量的改变。